属于类脂类软膏基质的有
A. 植物油
B. 蜂蜡
C. 液状石蜡
D. 羊毛脂
E. 凡士林

正确答案：B、D。蜂蜡；羊毛脂